扁茎黄芪的干燥成熟种子是
A. 南葶苈子
B. 菟丝子
C. 酸枣仁
D. 北葶苈子
E. 沙苑子

正确答案：E。沙苑子

解析：本题考查的是沙苑子的来源。扁茎黄芪的干燥成熟种子是沙苑子（E对）。沙苑子：【来源】为豆科植物扁茎黄芪的干燥成熟种子。南葶苈子（A错）与北葶苈子（D错）均为葶苈子。葶苈子：【来源】为十字花科植物播娘蒿或独行菜的干燥成熟种子。前者习称“南葶苈子”，后者习称“北葶苈子”。菟丝子（B错）：【来源】为旋花科植物南方菟丝子或菟丝子的干燥成熟种子。酸枣仁（C错）：【来源】为鼠李科植物酸枣的干燥成熟种子。